子宫内膜癌最多见的病理类型是
A. 腺角化癌
B. 腺癌
C. 透明细胞癌
D. 鳞腺癌
E. 鳞癌

正确答案：B。腺癌

解析：子宫内膜癌最多见的病理类型是腺癌（B对），占80%～90%。其他类型有：腺癌伴鳞状上皮分化包括腺角化癌（A错）和鳞腺癌（D错）、浆液性腺癌（占1%～9%）、透明细胞癌（约占5%）（C错）等。子宫内膜为腺上皮，故鳞癌少见（E错）。